穿过茎乳孔的神经是
A. 舌下神经
B. 下颌神经
C. 面神经
D. 副神经
E. 无

正确答案：C。面神经

解析：穿过茎乳孔的神经是面神经（C对）。舌下神经（A错）出颅的位置为舌下神经管。下颌神经（B错）出颅的位置为卵圆孔。副神经（D错）出颅的位置为颈静脉孔。